关于抗疟药，下列叙述正确的是
A. 氯喹对阿米巴痢疾有效
B. 氯喹可根治间日疟
C. 青蒿素治疗疟疾最大缺点是有一定的复发率
D. 伯氨喹可用作疟疾病因性预防
E. 乙胺嘧啶能引起急性溶血贫血

正确答案：C。青蒿素治疗疟疾最大缺点是有一定的复发率

解析：氯喹属于抗肠道外阿米巴病作用，其在肝脏中的浓度较高，可用于治疗阿米巴肝脓肿；氯喹对各种疟原虫的红细胞内裂殖体有较强的杀灭作用，但日间疟原虫对氯喹的耐药作用越来越明显；使用青蒿素治疗疟疾有一定的复发率；伯氨喹对日间疟和卵形疟肝脏中的休眠子有较强的杀灭作用，是防止疟疾远期复发的主要药物，并不做病因性预防；乙胺嘧啶不良反应可引起巨细胞性贫血、粒细胞减少等干扰人体四氢叶酸代谢的症状。掌握“氯喹、青蒿素、伯氨喹及乙胺嘧啶”知识点。